女婴，10个月，腹泻每日5～7次，水样便，伴呕吐2次，每日尿量较平日略少些，体检：前囟平，哭有泪，口唇略干，四肢温暖，无腹胀，皮肤弹性尚可，该儿腹泻病情为轻型与重型的区别点主要是
A. 有无发热呕吐
B. 每日大便〉10次以上为重型
C. 有无水、电解质紊乱
D. 大便含黏液、血性为重型
E. 镜检有大量脂肪滴为重型

正确答案：C。有无水、电解质紊乱

解析：【答案解析】患儿腹泻每日5～7次，水样便，伴呕吐2次，每日尿量较平日略少些，体检：前囟平，哭有泪，口唇略干，四肢温暖，无腹胀，皮肤弹性尚可（提示患儿轻度脱水），根据患儿的临床症状及体征，考虑最可能的诊断为轻型腹泻，该儿腹泻病情为轻型与重型的区别点主要是有无水、电解质紊乱（C对）及全身中毒感染症状，与消化道症状（A错）及大便次数（B错）、性状（DE错）无关。